重型成年霍乱患者第一个24小时的补液量是
A. 3000～5000
B. 4000～6000
C. 5000～7000
D. 4000～8000
E. 8000～12000

正确答案：E。8000～12000

解析：重型成年霍乱患者第一个24小时的补液量是8000～12000ml（E对）。3000～4000ml（A错）是轻型脱水者的第一个24小时的补液量，4000～8000ml（D错）是中型脱水者的第一个24小时的补液量。